多潘立酮可用于
A. 镇咳
B. 平喘
C. 祛痰
D. 止吐
E. 助消化

正确答案：D。止吐

解析：本题考查多潘立酮。多潘立酮可直接阻断胃肠道多巴胺D₂受体，促进胃肠蠕动和胃排空，增加胃窦和十二指肠运动，协调幽门的收缩，抑制恶心、呕吐（D对）；镇咳药（A错）主要有喷托维林、右美沙芬等；平喘药（B错）主要有沙丁胺醇、茶碱等；祛痰药（C错）主要有溴己新、氨溴索等；助消化（E错）的药物主要有胃蛋白酶、胰酶等。